对心肌缺血与心内膜下梗死的鉴别，最有意义的是
A. 淀粉酶
B. 血清转氨酶
C. 7-谷氨酰基转肽酶
D. 肌酸磷酸激酶
E. 血清碱性磷酸酶

正确答案：D。肌酸磷酸激酶

解析：心肌缺血与心内膜下梗死关键鉴别点在于是否有心肌坏死，而心肌坏死会引起心肌酶增高，而心肌酶包括肌钙蛋白、LDH、血清转氨酶、肌酸磷酸激酶（D对）等，这些心肌酶前特异性以肌钙蛋白最高，其次是肌酸磷酸激酶、LDH，最次是血清转氨酶。而淀粉酶（A错）主要来自胰腺和腮腺，急性胰腺炎是AMS增高最常见的原因。血清转氨酶（B错）、7-谷氨酰基转肽酶（C错）常见于肝脏损伤。碱性磷酸酶（E错）常作为肝脏疾病的检查指标之一，胆道疾病时可能由于ALP生成增加而排泄减少，而引起血清中碱性磷酸升高。